男，50岁，从1.5米高处摔下，右胸着地。体格检查：神清，呼吸34次/分，心率100次/分，血压130/75mmHg，右胸壁畸形，无伤口，出现反常呼吸，双肺呼吸音粗，无干湿啰音。身体其余部分无损伤。现场急救的最重要处理是
A. 静脉输液治疗
B. 给氧、镇静、止痛治疗
C. 加压包扎，迅速消除反常呼吸
D. 行气管插管、人工控制呼吸
E. 行气管切开术

正确答案：C。加压包扎，迅速消除反常呼吸

解析：中年男性患者，高处摔伤、右胸着地、右胸壁畸形（提示可能有肋骨骨折），出现反常呼吸（提示为多根多处肋骨骨折），无伤口（提示非开放性损伤），体格检查：神清，呼吸34次/分（高于正常值12～20次/分），心率100次/分（正常值为60～100次/分），血压130/75mmHg（正常值为90～140/60～90mmHg），提示患者一般情况良好，结合患者病史、症状和体征，应诊断为闭合性多根多处肋骨骨折。闭合性多根多处肋骨出现的反常呼吸运动（局部胸壁失去完整肋骨支撑而软化，出现吸气时软化区胸壁内陷，呼气时外突）可使伤侧肺受到塌陷胸壁的压迫，影响肺通气，导致缺氧和CO₂储留，严重时可发生呼吸和循环衰竭，因此，现场急救的最重要处理是及时加压包扎，迅速消除反常呼吸（C对）。静脉输液治疗（A错）和给氧、镇静、镇痛治疗（B错）为一般性治疗措施，不是现场急救最重要的处理。气管插管、人工控制呼吸（D错）和气管切开术（E错）为有创操作，主要用于咳嗽无力、呼吸道分泌物潴留的患者。